关于《土壤环境质量标准》新标准修订内容不正确的是
A. 标准名称由《土壤环境质量标准》调整为《农用地土壤环境质量标准》
B. 新标准中执行现行标准中的一级标准，不再规定全国统一的土壤环境背景值
C. 国家另行制定现行标准中的一级标准，指导各地分别确定土壤环境背景值并备案
D. 土壤污染物控制项目由10项增加至21项，分为基本项目和选测项目
E. 《土壤环境质量标准》修订后坚持土壤环境质量反退化原则

正确答案：B。新标准中执行现行标准中的一级标准，不再规定全国统一的土壤环境背景值

解析：本题考查《土壤环境质量标准》新标准修订内容。标准名称由《土壤环境质量标准》调整为《农用地土壤环境质量标准》（A对）。新标准修订的主要内容概括如下：1.土壤环境背景值：新标准取消现行标准中的一级标准，不再规定全国统一的土壤环境背景值（B错，为本题正确答案），自然保护区等依法需要特殊保护的地区，依据土壤环境背景值开展土壤环境质最评价与管理。国家另行制定“土壤环境背景值确定技术导则”，指导各地分别确定土壤环境背景值并备案（C对）。2.土壤污染物控制项目：土壤污染物控制项目由10项增加至21项，分为基本项目和选测项目两类（D对）。3.补充实施与监督要求：①各级环境保护主管部门依法履行环保统一监督管理职能，负责监督本标准的实施；②新标准作为国家环境质量标准应强制实施，实施标准的责任主体是地方各级人民政府；③农用地坚持土壤环境质量反退化原则（E对），即土壤中污染物含最低于标准限值的，应以控制污染物含最上升为目标，不应局限于“ 达标”；对于超标的土壤，应启动土壤污染详细调查、进一步开展风险评估，准确判断关键风险点及其成因，采取针对性管控或修复措施。